基础代谢率是以每小时下列哪一项为单位计算的产热量
A. 体重
B. 身高
C. 年龄
D. 体表面积
E. 环境温度

正确答案：D。体表面积